具有体内、外抗凝血作用的药物是
A. 肝素
B. 阿司匹林
C. 香豆素类
D. 链激酶
E. 右旋糖酐

正确答案：A。肝素